高温车间中暑抢救的首选措施是
A. 物理降温
B. 药物降温
C. 给氧
D. 纠正水电解质紊乱
E. 移出现场

正确答案：E。移出现场